水寒射肺属于
A. 相乘
B. 子病犯母
C. 母病及子
D. 相侮
E. 相生

正确答案：B。子病犯母

解析：水寒射肺证是指寒邪和水气侵犯肺脏而出现的肺气失宣,寒水逆阻等临床表现的概称。肺脏属金，金为水之母，此题为子病犯母（B对）。母病及子，指五行中的某一行异常，累及其子行，导致母子两行皆异常（C错）。相乘，指五行中所不胜一行对其所胜一行的过度制约或克制；相侮，指五行中所胜一行对其所不胜一行的反向制约和克制，相乘相侮属于五行相克关系的异常变化（AD错）。五行相生，指木、火、土 金、水之间存在着有序的递相资生、助长和促进的关系，属于五行之间正常状态下的规律（E错）。